在医疗实践活动中分配医疗收益与平衡时，类似的个案适用相同的准则，不同的个案适合不同的准则，这所体现的医学伦理基本原则是
A. 尊重原则
B. 不伤害原则
C. 公正原则
D. 有利原则
E. 公益原则

正确答案：C。公正原则

解析：公正原则是指以形式公正与内容公正的有机统一为依据分配和实现医疗受益与平衡的伦理原则，即具有同样医疗需要以及同等社会贡献和条件的人应得到同样的医疗待遇。反之，不同的病人则分别享受有差别的医疗待遇。因此在医疗实践活动中分配医疗收益与平衡时，类似的个案适用相同的准则，不同的个案适合不同的准则，这所体现的医学伦理基本原则是公正原则（C对）。不伤害原则是指在医务人员的整个医疗行为中，无论动机，还是效果，均应避免对病人造成伤害（B错）。尊重原则是指医务人员尊重病人的伦理原则（A错）。把病人的健康放在首位，切实为病人谋利益的原则是有利原则（D错）。医学伦理基本原则包括有利原则、公正原则、不伤害原则和尊重原则，不包括公益原则（E错）。